口服可以减少青霉素类和头孢菌素类抗生素排泄的是
A. 地西泮
B. 丙磺舒
C. 氯化钙
D. 氯化铵
E. 氨茶碱

正确答案：B。丙磺舒

解析：本题考查丙磺舒。丙磺舒（B对）口服可以减少青霉素类和头孢菌素类抗生素排泄。丙磺舒可与青霉素类药物竞争分泌蛋白，减少青霉素类的肾小管分泌从而延长其血浆半衰期，从而减少其排泄。地西泮（A错）主要经肾脏排泄。氯化钙（C错）为调节水、电解质平衡的药物。氯化铵（D错）为调节碱平衡的药物。氨茶碱（E错）为磷酸二脂酶抑制剂类平喘药。以上四种均不能减少青霉素和头孢类抗生素的排泄。